静脉注射后全部药物进入全身循环，生物利用度等于
A. 0.5
B. 0.2
C. 1
D. 0.3
E. 0.8

正确答案：C。1

解析：静脉注射后全部药物进入全身循环，生物利用度等于100%。掌握“药物消除及重要参数”知识点。